患者，男，60岁。脑溢血后长期卧床，2天前出现发热、咳嗽、呼吸困难等症状，胸透见两肺下叶有多数散在边缘不清小灶阴影。应首先考虑的是
A. 大叶性肺炎
B. 干酪样肺炎
C. 间质性肺炎
D. 转移性肿瘤
E. 小叶性肺炎

正确答案：E。小叶性肺炎

解析：患者中老年男性，且有长期卧床史，2天前出现发热、咳嗽、呼吸困难等症状，胸透见两肺下叶有多数散在边缘不清小灶阴影，患者临床表现与小叶性肺炎相符，故应首先考虑的诊断是小叶性肺炎（E对）。大叶性肺炎（P46）（A错）X线表现为大片炎症浸润影或实变影。干酪性肺炎（P67）（B错）多发生在机体免疫力和体质衰弱，又受到大量结核分枝杆菌感染的患者，X线影像呈大叶性密度均匀磨玻璃状阴影。间质性肺炎（C错）主要表现为活动后呼吸困难，X线表现为弥漫性阴影。转移性肿瘤（D错）常有原发肿瘤病史。